环烯醚萜苷具有的性质有
A. 旋光性
B. 易被酸水解而得到原苷的苷元
C. 味苦
D. 对酸稳定
E. 易溶于乙醚

正确答案：A、C。旋光性；味苦

解析：本题考查的是环烯醚萜化合物的理化性质。环烯醚萜苷具有的性质有旋光性（A对）与味苦（C对）。环烯醚萜化合物的理化性质：①性状：烯醚萜类化合物大多数为白色结晶或粉末（极少为液态）。分子中C-1、C-5、C-8、C-9多形成手性碳原子，故多具有旋光性。味苦或极苦。②溶解性：环烯醚萜类化合物多连有极性官能团，故偏亲水性，易溶于水和甲醇，可溶于乙醇、丙酮和正丁醇，难溶于三氯甲烷、乙醚（E错）和苯等亲脂性有机溶剂。环烯醚萜苷的亲水性较其苷元更强。③显色反应及检识：环烯醚萜苷易被水解，生成的苷元为半缩醛结构，其化学性质活泼，容易进一步发生氧化聚合等反应，难以得到结晶性苷元（B错），同时使颜色变深，如地黄及玄参等中药在炮制及放置过程中因此而变成黑色。苷元遇酸、碱、羰基化合物和氨基酸等都能变色（D错）。如车叶草苷与稀酸混合加热，能被水解、聚合产生棕黑色树脂状聚合物沉淀；若用酶水解，则显深蓝色，也不易得到结晶性苷元。游离的苷元遇氨基酸并加热，即产生深红色至蓝色，最后生成蓝色沉淀。因此，与皮肤接触，也能使皮肤染成蓝色。苷元溶于冰醋酸溶液中，加少量铜离子，加热显蓝色。这些显色反应，可用于环烯醚萜苷的检识及鉴别。